女性，48岁。反复双手近端指间关节、双膝关节痛伴晨僵2年，肘部伸侧可触及皮下结节，质硬无触痛。最有助于确定诊断的辅助检查是
A. 抗核抗体
B. 血沉
C. 血C反应蛋白
D. 影像学
E. 血抗链球菌溶血素“O”测定

正确答案：D。影像学

解析：中年女性患者，反复双手近端指间关节、双膝关节痛伴晨僵2年（类风湿关节炎典型关节表现），肘部伸侧可触及皮下结节，质硬无触痛（类风湿结节表现），诊断首先考虑为类风湿性关节炎。类风湿关节炎疑诊时，应做关节影像学检查和血清类风湿因子检测。关节影像学检查（D对）对于类风湿关节炎的诊断与分期非常重要。抗核抗体（A错）一般用于系统性红斑狼疮的诊断，不出现于类风湿关节炎中。血沉（B错）和C反应蛋白（C错）为一般炎症指标，主要和疾病的活动度有关，无法确定诊断。抗抗链球菌溶血素“O”测定（E错）有助于链球菌感染后变态反应性疾病如急性肾小球肾炎与风湿热的辅助诊断。